可选择制成散剂的药物有
A. 易吸湿或易氧化变质的药物
B. 刺激性大的药物
C. 腐蚀性强的药物
D. 含低共熔组分的药物
E. 挥发性成分多的药物

正确答案：D。含低共熔组分的药物

解析：本题考查的是散剂的特点。可选择制成散剂的药物有含低共熔组分的药物（D对）。散剂系指原料药物或与适宜的辅料经粉碎、均匀混合制成的干燥粉末状制剂。散剂的特点：①因药物粉末的比表面积较大，易分散，吸收、起效迅速。②制备简便。③外用对疮面有一定的机械性保护作用，多用于口腔科、耳鼻喉科、伤科和外科等，也适于小儿给药。但散剂易吸潮、药物成分易散失、氧化，所以易吸湿或易氧化变质的药物（A错）、刺激性大的药物（B错）、含挥发性成分（E错）多且剂量大的药物不宜制成散剂。腐蚀性强的药物（C错）宜制成线剂。